治外感风热、温病初起，能轻宣疏散的药物是
A. 金银花
B. 连翘
C. 蒲公英
D. 大青叶
E. 板蓝根

正确答案：A、B。金银花；连翘

解析：本题考查的是金银花与连翘的主治病证。治外感风热、温病初起，能轻宣疏散的药物是金银花（A对）与连翘（B对）。金银花：【主治病证】（1）外感热病，风热表证。（2）痈疮疖肿，肠痈，肺痈，乳痈。（3）热毒泻痢。连翘：【主治病证】（1）外感热病，风热表证。（2）痈肿疮毒，乳痈，肺痈，瘰疬痰核。（3）热淋涩痛。蒲公英（C错）：【主治病证】（1）乳痈，痈肿疮毒，各种内痈。（2）咽喉肿痛，目赤肿痛，毒蛇咬伤。（3）湿热黄疸，热淋涩痛。大青叶（D错）：【主治病证】（1）温病热入血分之高热、神昏、发斑。（2）丹毒，咽喉肿痛，口疮，痄腮，痈肿疮毒。板蓝根（E错）：【主治病证】（1）温病发热、头痛或发斑疹。（2）咽喉肿痛，痄腮，痈肿疮毒，丹毒，大头瘟疫。